关于肿瘤的恶性程度，正确的是
A. Ⅰ级分化细胞恶性程度高
B. Ⅲ级分化细胞接近正常分化程度
C. 高分化较低分化者核分裂多
D. 低分化者较高分化者DNA、RNA含量增多
E. Ⅰ级分化较Ⅲ级分化细胞排列紊乱

正确答案：D。低分化者较高分化者DNA、RNA含量增多

解析：病理学上，根据恶性肿瘤的分化程度、异型性、核分裂象数目等对其恶性程度进行分级，通常分为Ⅰ、Ⅱ、Ⅲ级。Ⅰ级为高分化，分化良好，因此恶性程度较低（A错）；Ⅲ级为低分化，与正常分化程度相差较大（B错）。由于Ⅰ级分化程度较高，与相应正常组织的差异越较小，故与分化程度较低的Ⅲ级相比，其细胞排列较整齐（E错）。细胞的核分裂象数目（异型性）与细胞的分化程度成反比，故高分化者较低分化者的核分裂少（C错）。肿瘤细胞的分化程度越低，恶性程度越高，则细胞的增殖能力越强，合成DNA和RNA的能力也越强，因此低分化者较高分化者DNA、RNA含量增多（D对）。